感染动物后引起母畜流产的病原体是
A. 布鲁氏菌
B. 炭疽芽胞杆菌
C. 鼠疫耶尔森菌
D. 钩端螺旋体
E. 空肠弯曲菌

正确答案：A。布鲁氏菌

解析：孕期动物对布鲁氏菌最易感，感染后常引起流产，但人感染后不引起流产。掌握“动物源性细菌”知识点。